中药的副作用指的是
A. 配伍不当出现的反应
B. 药不对证出现的不良反应
C. 达不到常规用量不能控制病情
D. 超过常规用量时出现的不适反应
E. 在常规剂量时出现的与疗效无关的不适反应

正确答案：E。在常规剂量时出现的与疗效无关的不适反应

解析：中药的副作用是指中药在常用治疗剂量下出现的与治疗需要无关的不适反应（E对）。